男，57岁，心前区疼痛2年，多于安静状态发生，近日于睡眠中突发心前区疼痛。查心电图ST段抬高，冠脉造影见一过性狭窄。予硝苯地平治疗的主要药理学依据是
A. 选择性扩张外冠状动脉，增加心肌供血
B. 显著减慢心率，降低心肌耗氧量
C. 选择性增加心内膜下心肌供氧
D. 显著抑制心肌收缩力，降低心肌耗氧量
E. 抑制或逆转心肌肥厚，降低心肌耗氧量

正确答案：A。选择性扩张外冠状动脉，增加心肌供血

解析：中年男性，既往心前区疼痛，多于安静状态下发生（不稳定性心绞痛的特征性表现），近日于睡眠中突发心前区疼痛，实验室检查：心电图ST段抬高（提示心肌缺血），冠脉造影见一过性狭窄（提示冠脉痉挛），根据该患者的病史、临床表现及体征、实验室检查该病最可能的诊断为变异性心绞痛，硝苯地平治疗该病疗效最佳，它的主要药理学依据是选择性扩张外冠状动脉，增加心肌供血（A对），而对心肌并不存在负性肌力和负性频率的作用。